下列有关乳突窦的描述,不正确的是
A. 是鼓室和乳突小房间的小腔
B. 向前开口于鼓室
C. 向后与乳突小房相连通
D. 为中耳鼓室的后壁
E. 骨迷路内有前、后、外三个半规管

正确答案：D。为中耳鼓室的后壁

解析：乳突窦位于鼓室上隐窝的后方，向前开口于鼓室（B对），向后与乳突小房相连通（C对），为鼓室和乳突小房之间的小腔（A对）。鼓室后壁为乳突壁（D错，为本题正确答案）。E选项与题干无关。